兴奋性是指可兴奋细胞对刺激产生什么的能力
A. 反应
B. 反射
C. 兴奋
D. 抑制
E. 适应

正确答案：C。兴奋